女，34岁。寒战、高热、咳血痰1周。2周前干农活时右小腿外伤。查体：T39.7℃，神志清楚，精神差，双肺未闻及干湿性啰音，右外髁上方可见小脓痂。血常规WBC17×10⁹/L，N0.95。胸部X线片发现右下肺、左上肺类圆型阴影，其内可见空洞及液平。该患者最可能的诊断是
A. 血源性肺脓肿
B. 真菌性肺炎
C. 吸入性肺脓肿
D. 肺结核
E. 革兰阴性杆菌肺炎

正确答案：A。血源性肺脓肿

解析：患者为中年女性，寒战、高热、咳血痰1周，血常规WBC17×10⁹/L（正常值4～10×10⁹/L），N0.95（正常值0.4～0.75），提示存在感染，胸部X线片可见右下肺、左上肺类圆型阴影（为肺脓肿的典型胸片改变），其内可见空洞及液平，提示肺脓肿。患者2周前有右小腿外伤史（血源性肺脓肿的常见原因），提示血源性肺脓肿（A对）可能性比较大。真菌性肺炎（B错）（P54）常继发于婴幼儿肺炎、肺结核、糖尿病、血液病，广泛使用广谱抗菌素和激素等是主要诱因。吸入性肺脓肿（C错）（P58）多有齿、口、咽喉的感染灶，或手术、醉酒、劳累、受凉和脑血管病等病史，多为厌氧菌感染，咳痰有脓臭味。肺结核（D错）（P65）患者常有结核的全身症状，如发热盗汗症状，多为午后潮热，倦怠乏力、食欲减退和体重减轻等，X线胸片显示空洞壁较厚，一般无气液平面。革兰阴性杆菌肺炎（E错）多见于年老体弱或原有慢性支气管肺疾病患者，亦可通过机械呼吸器、雾化器或各种导管而感染。其它选项疾病的诱因和症状均与血源性肺脓肿不同，故可排除。